下列哪项属于典型的“以常达变”诊断原理
A. 见呕吐知病在胃
B. 以呼吸辨脉之至数
C. 问病史以了解痼疾
D. 闻咳声知病在肺
E. 发热口渴多热证

正确答案：B。以呼吸辨脉之至数

解析：“以常达变”是指在认识正常的基础上，辨别、发现太过、不及的异常变化，在认识呼吸的基础上辨别脉搏的频率（B对）。“司外揣内”是通过诊察其外部的征象，便有可能测知内在的变化情况；通过呕吐的外部征象测知内在病变在胃，从咳声的变化反映出病变在肺属于“司外揣内”的诊断原理（AD错）。“见微知著”是指机体的某些局部的、微小的变化，常包含着整体的生理、病理信息，局部的细微变化常可反映出整体的状况，整体的病变可以从多方面表现出来，从问病史反映痼疾情况（C错）。“因发知受”是根据机体在疾病中所反应的证候特征，确定是寒是热，是风是湿，这种寒、热或风、湿，不是根据气候变化或气温、湿度高低做出判断，从发热口渴的证候特征确定热证（E错）。